关于膜剂的说法，错误的是
A. 可供口服、口含、舌下或黏膜给药
B. 可制成单层膜、多层膜和夹心膜
C. 载药量高
D. 起效快
E. 重量差异不易控制

正确答案：C。载药量高

解析：本题考查膜剂的概述。膜剂仅适用于剂量小的药物，载药量少（C错，为本题正确答案）。膜剂指药物与适宜的成膜材料经加工制成的膜状制剂，可供口服、口含、舌下或黏膜给药，可制成单层膜、多层膜和夹心膜。膜剂成膜材料较其他剂型用量少、含量准确、起效快。